氧化锌丁香油水门汀的性能特点是
A. 对牙髓有安抚作用
B. 不溶于唾液
C. 对牙髓有较强刺激作用
D. 抗压强度好

正确答案：A。对牙髓有安抚作用

解析：本题考查氧化锌丁香油水门汀的性能特点。氧化锌丁香油水门汀的性能特点是对牙髓有安抚作用（A对）。氧化锌丁香油水门汀对牙髓的刺激性很小（C错），对牙髓有安抚作用，可用于可复性牙髓炎的镇痛安抚治疗。该水门汀与唾液长时间接触的溶解率大于除氢氧化钙水门汀以外的所有其他水门汀，不溶于唾液（B错）不是氧化锌丁香油水门汀的性能特点。该水门汀强度较低，抗压强度差（D错），不能作为银汞合金的垫底材料。